用于紧急避孕的药物是
A. 左炔诺孕酮
B. 黄体酮
C. 甲睾酮
D. 罗格列酮
E. 丁螺环酮

正确答案：A。左炔诺孕酮

解析：本题考查避孕药。用于紧急避孕的药物是左炔诺孕酮（A对）。紧急避孕药主要有雌激素-孕激素复方制剂（复方左炔诺孕酮片)，单孕激素制剂（左炔诺孕酮片）及抗孕激素制剂（米非司酮）3大类。黄体酮（B错）是天然孕激素，主要用于先兆性流产和功能性子宫出血等。甲睾酮（C错）是雄激素类药，临床用于功能性子宫出血、绝经期综合征和子宫肌瘤。罗格列酮（D错）是口服降糖药。丁螺环酮（E错）为抗焦虑症药。